定喘汤的功用是
A. 辛凉宣泄、清肺平喘
B. 宣肺平喘、清热祛痰
C. 降气平喘、祛痰止咳
D. 宣降肺气、清热祛痰
E. 解表散寒、清热祛痰

正确答案：D。宣降肺气、清热祛痰

解析：定喘汤中含麻黄以宣肺并散风寒；白果敛肺；桑白皮泻肺；黄芩清热化痰；并佐以杏仁、苏子、半夏、款冬花以降气平喘，诸药共奏宣降肺气，清热化痰之功（D对）。